女，25岁，妊娠5个月，因转移性右下腹痛2小时就诊。经检查诊断为急性阑尾炎，其治疗措施错误的是
A. 行阑尾切除术
B. 围手术期加用黄体酮
C. 手术切口应偏低
D. 尽量不用腹腔引流
E. 可应用广谱抗生素

正确答案：C。手术切口应偏低

解析：青年女性患者，诊断为妊娠中期（妊娠第14～27周末）急性阑尾炎。妊娠中期子宫增大较快，炎症发展易致流产或早产，威胁母子生命安全，需早期行阑尾切除术（A对）。妊娠期间盲肠和阑尾被增大的子宫推挤向右上腹移位，手术切口须偏高（C错，为本题正确答案），操作要轻柔，以减少对子宫的刺激。黄体酮又名孕酮，是由卵巢黄体分泌的一种天然孕激素，其可降低子宫平滑肌的兴奋性和对各种刺激的敏感性，有助于维持妊娠。因此，围手术期应加用黄体酮，以减少子宫收缩避免早产（B对）。尽量不用腹腔引流（D对），以减少对子宫的刺激，防止早产。术后使用广谱抗生素防治感染（E对）。